能将心肌的兴奋与收缩联系在一起的因子是
A. Ca²⁺
B. Mg²⁺
C. CI-
D. K⁺
E. Na⁺

正确答案：A。Ca²⁺

解析：心肌兴奋是电活动，而收缩是机械活动，将心肌的兴奋与收缩联系在一起的因子是Ca2+（A对）。心肌细胞兴奋使细胞膜L型钙通道开放，Ca2+顺浓度梯度进入细胞，并激活肌浆网内的Ca2+释放。而后胞质Ca2+与肌钙蛋白结合，引起心肌收缩。